有关肱骨，正确的描述是
A. 肱骨头朝向上、前、内
B. 头周围的浅沟称为外科颈
C. 肱骨小头位于下端外侧部
D. 内上髁的前方有尺神经沟
E. 体后面中部有自外上斜向内下的桡神经沟

正确答案：C。肱骨小头位于下端外侧部

解析：肱骨上端有朝向上后内方呈半球形的肱骨头，头周围的环状浅沟，称解剖颈（AB错）。肱骨下端较扁，外侧部前面有半球状的肱骨小头, 与桡骨相关节（C对）。内上髁后方的浅沟称尺神经沟（D错），肱骨体后面中部可见自内上斜向外下的浅沟，称桡神经沟（E错）。